下列哪项是火邪、燥邪、暑邪共同的致病特点
A. 耗气
B. 上炎
C. 伤津
D. 动血
E. 生风

正确答案：C。伤津

解析：火为阳邪，其致病具有炎热升腾的特性，其性燔灼趋上，易扰心神，易耗气伤津、生风动血，易致疮痈。燥邪致病具有干燥、收敛的特性，其性干涩，易伤津液，并易伤肺脏。暑为阳邪，其致病具有炎热、升散的特性，能扰神伤津耗气，多挟湿邪。火邪、暑邪均能耗气，而燥邪无耗气的致病特点（A错）。上炎不是燥邪的致病特点（B错）。火邪、暑邪、燥邪均能伤津（C对）。生风、动血为火邪的致病特点（DE错）。